前臂外侧部皮肤感觉消失是哪条神经受损
A. 桡神经
B. 正中神经
C. 肌皮神经
D. 尺神经
E. 腋神经

正确答案：C。肌皮神经

解析：桡神经（A错）损伤后导致臂伸肌群的瘫痪，表现为抬前臂时呈＂垂腕”状。正中神经（B错）损伤后表现为鱼际肌萎缩，手掌变平呈＂猿掌＂。肌皮神经（C对）损伤后表现为屈肘无力以及前臂外侧部皮肤感觉的减弱。尺神经（D错）损伤后，掌指关节过伸，出现“爪形手”。腋神经（E错）损伤后为臂不能外展，肩部和臂外上部皮肤感觉障碍。